口腔黏膜损害以哪一型天疱疮最多见
A. 增殖型天疱疮
B. 大疱型天疱疮
C. 落叶型天疱疮
D. 寻常型天疱疮
E. 红斑型天疱疮

正确答案：D。寻常型天疱疮

解析：天疱疮可分为四型：寻常型、增殖型、落叶型和红斑型天疱疮。口腔内常见的是寻常型天疱疮，增殖型也有发生。落叶型和红斑型口腔病损少见。掌握“天疱疮”知识点。